病原微生物分为几类
A. 2
B. 3
C. 5
D. 4
E. 6

正确答案：D。4